雷尼替丁属于
A. M受体阻断药
B. H⁺，K⁺-ATP酶抑制药
C. H₁受体阻断药
D. 胃泌素受体阻断药
E. H₂受体阻断药

正确答案：E。H₂受体阻断药

解析：本题考查抑制胃酸分泌药-H₂受体阻断药。雷尼替丁属于H₂受体阻断药（E对）。抑制胃酸分泌药包括：H₂受体阻断药、H⁺-K⁺-ATP酶抑制药（B错）、M胆碱受体阻断药（A错）及胃泌素阻断药（D错）。西咪替丁（甲氰咪胍）、雷尼替丁、法莫替丁和尼扎替丁为临床常用的H₂受体阻断药。